男，40岁。车祸外伤后10小时，当时无昏迷，入院时查体：神志清楚，答话切题。右侧肢体肌力4级，霍夫曼征阳性。头颅X线平片及CT均提示左顶骨凹陷性骨折，直径3cm，深度2cm。正确的治疗是
A. 抗感染治疗
B. 手术摘除凹陷的的骨折碎片，解除对脑组织的压迫
C. 观察病情变化，决定下一步的治疗方案
D. 脱水治疗
E. 保守治疗，应用神经营养剂

正确答案：B。手术摘除凹陷的的骨折碎片，解除对脑组织的压迫

解析：青年男性患者，车祸外伤，无昏迷，神志清、答话切题（提示无脑损伤和颅内血肿），右侧肢体肌力4级，霍夫曼征阳性（脑组织受压的表现），头颅X线平片及CT均提示左顶骨凹陷性骨折，深度2cm（提示脑组织受压），结合患者病史、临床表现和影像学检查，应诊断为左顶骨凹陷性骨折。该患者颅骨凹陷深度2cm，且有脑功能区受压的表现，因此，正确的治疗是手术摘除凹陷的的骨折碎片，解除对脑组织的压迫（B对）。抗感染治疗（A错），观察病情变化，决定下一步的治疗方案（C错），保守治疗，应用神经营养剂（E错）均为一般性治疗措施，多作为术后辅助治疗。该患者未出现明显的颅内高压症状，不需要脱水治疗（D错）。